下列哪种情志异常可引起二便失禁
A. 过度悲忧
B. 恐惧过度
C. 思虑不解
D. 过度愤怒
E. 突然受惊

正确答案：B。恐惧过度

解析：恐则气下：指过度恐惧伤肾，致使肾气不固、气陷于下的病机变化，临床可见大恐引起的二便失禁（B对），甚则遗精等症。悲则气消：指过度悲忧伤肺，导致肺气耗伤、肺失宣降的病机变化，临床常见精神不振，意志消沉，胸闷气短，懒言乏力等症（A错）。思则气结：指过度思虑伤脾，导致脾气结滞、运化失职的病机变化，临床可见精神萎靡，反应迟钝，不思饮食，腹胀纳呆，便溏等症状（C错）。怒则气上：指过怒导致肝气疏泄太过，气机上逆，甚则血随气逆、并走于上的病机变化，临床主要表现为头胀头痛，面红目赤，甚则呕血、昏厥卒倒等（D错）。喜则气缓：指过度喜乐而伤心，导致心气涣散不收，重者心气暴脱、神不守舍的病机变化，临床可见精神不集中，神志失常，狂乱，或见心气暴脱的大汗淋漓，气息微弱，脉微欲绝等症（E错）。